第一类医疗器械的是
A. 助听器
B. 针灸针
C. 血压计
D. 消毒器具
E. 脱脂医用纱布

正确答案：D。消毒器具

解析：本题考查的是医疗器械分类。第一类医疗器械的是消毒器具（D对）。第一类是风险程度低，实行常规管理可以保证其安全、有效的医疗器械。第二类是具有中度风险，需要严格控制管理以保证其安全、有效的医疗器械。第三类是具有较高风险，需要采取特别措施严格控制管理以保证其安全、有效的医疗器械。助听器（A错）属于第二类医疗器械。针灸针（B错）属于第二类医疗器械。血压计（C错）属于第二类医疗器械。脱脂医用纱布（E错）属于第二类医疗器械。